男，30岁。因胸闷、胸痛到某医院做冠状动脉CT检查，注射造影剂后患者立即出现休克，经抢救无效死亡，医患双方发生纠纷。后经鉴定，认为患者死亡系临床中极为少见的造影剂过敏所致。根据《医疗事故处理条例》，该事件性质属于
A. 医疗事故，医方承担主要责任
B. 医疗意外，医方不承担责任
C. 医疗事故，医方承担轻微责任
D. 医疗事故，医方承担全部责任
E. 医疗事故，医方不承担责任

正确答案：B。医疗意外，医方不承担责任

解析：《医疗事故处理条例》规定了6种情形不属于医疗事故：①在紧急情况下为抢救垂危患者生命而采取紧急医学措施造成不良后果的；②在医疗活动中由于患者病情异常或者患者体质特殊而发生医疗意外的（B对）；③在现有医学科学技术条件下，发生无法预料或者不能防范的不良后果的；④无过错输血感染造成不良后果的；⑤因患方原因延误诊疗导致不良后果的；⑥因不可抗力造成不良后果的。